肾结核多来源于
A. 骨结核
B. 肠结核
C. 肺结核
D. 膀胱结核
E. 生殖系结核

正确答案：C。肺结核

解析：泌尿、男性生殖系统结核是全身结核病的一部分，其中最主要是肾结核，肾结核绝大多数起源于肺结核（C对），少数继发于骨关节结核（A错）或消化道结核（B错）。结核分枝杆菌自原发感染灶（大多均为肺结核灶）经血行播散引起肾结核，如未及时治疗，结核分枝杆菌随尿液下行可播散到输尿管、膀胱（D错）、尿道致病，还可以通过前列腺导管、射精管进入男生殖系统，引起生殖系结核（E错）（P544）。